病后可获得持久免疫的病毒是
A. 流感病毒
B. 呼吸道病毒
C. 鼻病毒
D. 冠状病毒
E. 腮腺炎病毒

正确答案：E。腮腺炎病毒

解析：腮腺炎病后可获牢固的免疫力。掌握“正、副黏病毒”知识点。